属于H₁受体阻断剂，可用于治疗季节性过敏性鼻炎的药物是
A. 氨溴索
B. 羟甲唑啉
C. 度米芬
D. 西地碘
E. 左卡巴斯汀

正确答案：E。左卡巴斯汀

解析：本题考查左卡巴斯汀。属于H₁受体阻断剂，可用于治疗季节性过敏性鼻炎的药物是左卡巴斯汀（E对）。氨溴索（A错）为多糖纤维素分解剂，主要用于痰液黏稠不宜咳出者。羟甲唑啉（B错）是α受体激动剂，用于鼻炎或鼻塞。度米芬（C错）属于阳离子型表面活性剂，可用于治疗咽喉炎。西地碘（D错）适用于慢性咽炎、复发性口腔溃疡或者糜烂型扁平苔藓，也可以适用于白念珠菌感染、慢性牙龈炎或者牙周炎的患者。